李某，某公司经理，体型肥胖，初诊痛风患者，如果为其选择优质蛋白质，适宜的食物为
A. 动物内脏
B. 蛋类
C. 肉类
D. 禽类
E. 鱼类

正确答案：B。蛋类

解析：本题考查痛风病人适宜选择的优质蛋白质食物。痛风病人应限制蛋白质的摄入量从而控制嘌呤的摄取，适宜选择的优质蛋白质食物为蛋类（B对ACDE错）、牛奶等。